三七的功效是
A. 凉血散瘀
B. 温经止血
C. 活血定痛
D. 解毒敛疮
E. 清热生津

正确答案：C。活血定痛

解析：本题考查的是三七的功效。三七的功效是活血定痛（C对）。三七：【功效】化瘀止血，活血定痛。小蓟：【功效】凉血止血，散瘀（A错）消痈。艾叶：【功效】温经止血（B错），散寒止痛。地榆：【功效】凉血止血，解毒敛疮（D错）。白茅根：【功效】凉血止血，清热生津（E错），利尿通淋。